静脉注射某药，X₀=60mg，若初始血药浓度为15㎍／ml，其表观分布容积V为
A. 20L
B. 4ml
C. 30L
D. 4L
E. 15L

正确答案：D。4L

解析：本题考查表观分布容积。表观分布容积是体内药量与血药浓度间相互关系的一个比例常数，用“V”表示，它是指给药剂量或体内药量与血浆药物浓度的比值，即V=X/C=60mg/15㎍/ml=60×10³㎍/15㎍/ml=4000ml=4L（D对），X为体内药物量，V是表观分布容积，C是血药浓度。